坐骨海绵体肌
A. 覆盖在尿道球的表面
B. 起自坐骨棘
C. 止于阴茎脚的表面
D. 收缩时压迫尿道球
E. 使尿道缩短变细

正确答案：C。止于阴茎脚的表面

解析：止于阴茎脚的表面（C对）为坐骨海绵体肌。